能开郁醒脾的药是
A. 陈皮
B. 青皮
C. 枳实
D. 柿蒂
E. 甘松

正确答案：E。甘松

解析：本题考查的是甘松的功效。能开郁醒脾的药是甘松（E对）。甘松：【功效】行气止痛，开郁醒脾。陈皮（A错）：【功效】理气调中，燥湿化痰。青皮（B错）：【功效】疏肝破气，消积化滞。枳实（C错）：【功效】破气消积，化痰除痞。柿蒂（D错）：【功效】降气止呃。